胃癌扩散至横结肠，其最可能的转移方式属于
A. 血性转移
B. 淋巴转移
C. 直接浸润
D. 跳跃转移
E. 腹膜种植转移

正确答案：C。直接浸润

解析：胃癌的扩散与转移（1）直接浸润（C对）：浸润性生长的胃癌突破浆膜后，易扩散至网膜、结肠、肝、脾、胰腺等邻近器官。（2）淋巴转移（B错）：是胃癌的主要转移途径。引流胃的淋巴结分为16组，胃癌的淋巴结转移通常是循序渐进，即先由原发部位经淋巴网向胃周淋巴结转移（1-6组），继之癌细胞随支配胃的血管，沿血管周围淋巴结向心性转移，并可向更远重要血管周围转移（7-16组）；但有时也可发生跳跃式淋巴转移（D错），终末期胃癌可经胸导管向左锁骨上淋巴结转移，或经肝圆韧带转移至脐部。（3）血行转移（A错）：胃癌细胞进入门静脉或体循环向身体其他部位播散，形成转移灶。常见转移的器官有肝、肺、胰、骨骼等，以肝转移为多。（4）腹膜种植转移（E错）：当胃癌组织浸润至浆膜外后，肿瘤细胞脱落并种植在腹膜和脏器浆膜上，形成转移结节。直肠前凹的转移癌，直肠指检可以发现。女性病人胃癌可形成卵巢转移性肿瘤，称Krukenberg瘤（P346-P347）。